我国法定传染病报告属于
A. 主动监测
B. 被动监测
C. 哨点监测
D. 以实验室为基础的监测系统
E. 以医院为基础的监测系统

正确答案：B。被动监测